鼓索叙述错误的是
A. 出茎乳孔后由面神经发出
B. 随舌神经分布
C. 含有两种纤维成分
D. 味觉纤维分布于舌前2/3味蕾
E. 一般内脏运动纤维需交换神经元

正确答案：A。出茎乳孔后由面神经发出

解析：鼓索为面神经出茎乳孔前发出的分支（A错，为本题正确选项），返回鼓室，穿岩鼓裂出鼓室，行向前下加入舌神经（B对）。鼓索含有味觉纤维和副交感纤维（C对），前者随舌神经分布于舌前2/3的味蕾（D对），后者进入下颌下神经节，更换神经元（E对）后控制舌下腺和下颌下腺的分泌。